诺氟沙星注射液与氨苄青霉素钠注射液混合析出沉淀，其原因是
A. pH值改变
B. 离子作用
C. 溶剂组成改变
D. 盐析作用
E. 直接反应

正确答案：A。pH值改变

解析：本题考查药物的配伍变化。诺氟沙星注射液与氨苄青霉素钠注射液混合析出沉淀，其原因是pH值改变（A对）。注射剂配伍变化的主要原因：1.溶剂组成改变（C错）。某些含有非水溶剂的制剂与输液配伍，由于溶剂的改变使药物析出。如地西泮注射液与5%葡萄糖、0.9%氯化钠或0.167mol/L乳酸钠注射液配伍时，易析出沉淀。2.pH的改变。凡两种药物溶液中 pH相差较大，发生配伍变化的可能性也大。pH的变化可引起沉淀析出与变色。如新生霉素与5%葡萄糖，诺氟沙星与氨苄西林配伍会发生沉淀；磺胺嘧啶钠、谷氨酸钠（钾）、氨茶碱等碱性药物可使肾上腺素变色。3.缓冲容量。4.离子作用（B错）。有些离子能加速药物的水解反应，如乳酸根离子会加速氨茉西林钠和青霉素G的水解。5.直接反应（E错）。某些药可直接与输液中的一种成分反应。如四环素与含钙盐的输液在中性或碱性下，会产生不溶性赘合物。除Ca²⁺外，四环素还能与Fe³⁺形成红色、Al³⁺形成黄色、Mg²⁺形成绿色的螯合物。6.盐析作用（D错）。胶体分散体系加到含有电解质的输液中，会因盐析作用而产生凝聚。如两性霉素B注射液，只能加入5%葡萄糖注射液中静脉滴注。如果在大量电解质的输液中则能被电解质盐析出来，以致胶体粒子凝聚而产生沉淀。7.配合量。8.混合顺序。9.反应时间。10.氧与二氧化碳的影响。11.光敏感性。12.成分的纯度。